某男，30岁。患慢性胃炎数年，症见胃脘灼热疼痛、痞胀不适、口干口苦、纳少消瘦、手足心热，经服养胃舒胶囊取效，此因该中成药的功能有
A. 益气养阴
B. 健脾补肾
C. 健脾和胃
D. 疏肝和胃
E. 行气导滞

正确答案：A、C、E。益气养阴；健脾和胃；行气导滞

解析：本题考查的是养胃舒胶囊的功能。慢性胃炎数年，症见胃脘灼热疼痛、痞胀不适、口干口苦、纳少消瘦、手足心热，经服养胃舒胶囊取效，此因该中成药的功能有益气养阴（A对）、健脾和胃（C对）与行气导滞（E对）。养胃舒胶囊：【功能】益气养阴，健脾和胃，行气导滞。参芪降糖胶囊：【功能】益气养阴，健脾补肾（B错）。小柴胡颗粒：【功能】解表散热，疏肝和胃（D错）。